男，30岁，头部外伤6小时，伤后有一过性意识障碍，3小时后再次出现昏迷。检查左颞部头皮血肿，左瞳孔散大。CT扫描显示左侧颞叶硬膜外血肿。颞叶硬膜外血肿已引起
A. 原发性脑水肿
B. 继发性脑水肿
C. 原发性脑干损伤
D. 小脑幕切迹疝
E. 枕骨大孔疝

正确答案：D。小脑幕切迹疝

解析：青年男性患者，头部外伤，伤后有一过性意识障碍，之后再次出现昏迷（硬膜外血肿的典型表现），检查左颞部头皮血肿，左瞳孔散大（左侧动眼神经麻痹的表现，提示左侧小脑幕切迹疝），CT扫描显示左侧颞叶硬膜外血肿，结合患者病史、临床表现和影像学检查，应诊断为左侧颞叶硬膜外血肿并小脑幕切迹疝（D对）。原发性（A错）或继发性脑水肿（B错）主要表现为头痛、呕吐等颅内压增高的症状，可有偏瘫、失语等局灶症状和体征，一般无瞳孔改变。原发性脑干损伤（C错）的典型表现为伤后即刻发生持续性昏迷，意识障碍进行性加深，早期各种反射消失，病情稳定后可出现偏瘫、肌张力增高、腱反射亢进等表现。枕骨大孔疝（E错）时瞳孔大小多变，可忽大忽小。